与牙槽骨吸收有关的两种细胞一种是破骨细胞，另一种是
A. 中性粒细胞
B. 单核细胞
C. T淋巴细胞
D. B淋巴细胞
E. 巨噬细胞

正确答案：B。单核细胞

解析：本题考查与牙槽骨吸收有关的两种细胞。与牙槽骨吸收有关的两种细胞一种是破骨细胞，另一种是单核细胞（B对），破骨细胞主要去除骨的矿物部分，单核细胞在降解有机基质方面起作用。中性粒细胞（A错）、T淋巴细胞（C错）、B淋巴细胞（D错）、巨噬细胞（E错）都是牙周炎进展过程中存在于牙龈结缔组织中的炎细胞，主要与牙龈的炎症、牙周袋的形成有关，与牙槽骨吸收无关。